对苯海索的叙述，哪项错误
A. 阻断中枢胆碱受体
B. 对帕金森病疗效不如左旋多巴
C. 对氯丙嗪引起的震颤麻痹无效
D. 对僵直和运动困难疗效差
E. 外周抗胆碱作用比阿托品弱

正确答案：C。对氯丙嗪引起的震颤麻痹无效